关于霍乱，错误的描述是
A. 属于烈性传染病
B. 引起霍乱的致病菌是O₂血清群霍乱弧菌
C. 病愈后，少数病人可长期带菌
D. 霍乱弧菌的致病物质包括菌毛、鞭毛和霍乱肠毒素
E. 接种霍乱死菌苗可增强人群的特异性免疫力

正确答案：B。引起霍乱的致病菌是O₂血清群霍乱弧菌